男性，49岁。平素健康，突然发热发冷，咳嗽，用青霉素后热不退，10天后咳大量脓臭痰，诊断可能为
A. 肺结核
B. 支气管扩张症
C. 肺炎球菌肺炎
D. 急性肺脓肿
E. 支气管胸膜瘘

正确答案：D。急性肺脓肿

解析：患者为中年男性，有发热、咳嗽，用青霉素后热不退，10天后咳大量脓臭痰的表现（为肺脓肿的典型临床表现），根据其临床表现和体征，考虑诊断为急性肺脓肿（D对）。患者为突然发热，而肺结核（P65）（A错）起病缓慢，病程长，常有低热、盗汗、乏力、消瘦等结核毒性症状，发热多为长期午后潮热。支气管扩张（P38）（B错）多见于少年儿童，多有慢性咳嗽且病程较长，咳大量脓痰和（或）反复咯血，该患者为突然发生的咳嗽、发热，咳脓痰，故不考虑支气管扩张。肺炎链球菌肺炎（P46）（C错）是由肺炎链球菌所引起的肺炎，通常急骤起病以高热、寒战、咳嗽、血痰及胸痛为特征，且用青霉素治疗有效。气管胸膜瘘（E错）是由多种原因引起的支气管与胸膜间形成的异常通道，如结核性脓胸、大叶性肺炎、肺脓肿及术后感染等，表现为频发性咳嗽、咳脓性痰，其程度除了与瘘口的大小和胸膜腔脓液量的多少有关外，体位改变常影响症状的轻重。